在队列研究分析阶段，利用分层分析和多因素分析模型，主要是为了控制
A. 选择偏倚
B. 信息偏倚
C. 失访偏倚
D. 混杂偏倚
E. 回忆偏倚

正确答案：D。混杂偏倚